硅沉着病诊断分期的最主要依据是
A. 接触矽尘的职业史
B. 临床症状和体征
C. 矽尘的浓度
D. 化验检查
E. X线胸片

正确答案：E。X线胸片